源于茜草科，长于消肿散结的药是
A. 芫花
B. 京大戟
C. 牵牛子
D. 番泻叶
E. 红大戟

正确答案：E。红大戟

解析：本题考查红大戟的来源和功效。源于茜草科，长于消肿散结的药是红大戟（E对）。红大戟【来源】茜草科植物红大戟的干燥块根。【功效】泻水逐饮，消肿散结。芫花（A错）【来源】瑞香科植物芫花的干燥花蕾。【功效】泻水逐饮，祛痰止咳。外用杀虫疗疮。京大戟（B错）【来源】大戟科植物大戟的干燥根。【功效】泻水逐饮，消肿散结。牵牛子（C错）【来源】旋花科植物裂叶牵牛或圆叶牵牛的干燥成熟种子。【功效】泻下，逐水，去积，杀虫。番泻叶（D错）【来源】豆科植物狭叶番泻或尖叶番泻的干燥小叶。【功效】泻热通便，消积健胃。